下面哪种物质可引起肝血管肉瘤
A. 二异氰酸甲苯酯
B. 含氟塑料
C. 氯乙烯
D. 聚丙烯
E. 聚氯乙烯

正确答案：C。氯乙烯